疾病轮状模型的外环是指
A. 环境
B. 遗传因子
C. 宿主
D. 生物环境
E. 社会环境

正确答案：A。环境